某药师欲制备含有毒剧药物的散剂，但药物的剂量仅为0.0005g，故应先制成
A. 10倍散
B. 50倍散
C. 100倍散
D. 500倍散
E. 1000倍散

正确答案：E。1000倍散